在月经期避免过度劳累是为了避免
A. 疲劳过度
B. 睡眠不安
C. 食欲不振
D. 腰酸腿痛
E. 盆腔充血

正确答案：E。盆腔充血

解析：本题考查女性经期卫生的保健要点。女性在经期应适当参加体力活动，避免过度劳累而引起的盆腔充血（E对ABCD错）。注意经期卫生是保持生殖健康的必要措施：①月经期间要经常用温开水冲洗外阴，保持外阴部清洁；②使用清洁、吸水性强的卫生巾；③保持精神愉快；④适当参加体力活动，避免过度劳累而引起的盆腔充血；⑤生活规律，保证充足的睡眠，合理安排饮食，少吃辛辣生冷食物。